X线胸片中，有总密集度2级的小阴影，分布范围超过4个肺区，属于（）期尘肺
A. 0
B. Ⅰ
C. Ⅱ
D. Ⅲ

正确答案：C。Ⅱ

解析：本题考查尘肺Ⅱ期诊断标准。有下列表现之一者可诊断为尘肺Ⅱ期（C对ABD错）：①有总体密集度2级的小阴影，分布范围超过4个肺区；②有总体密集度3级的小阴影，分布范围达到4个肺区；③接触石棉粉尘，有总体密集度1级的小阴影，分布范围超过4个肺区，同时出现胸膜斑并已累及部分心缘或膈面；④接触石棉粉尘，有总体密集度2级的小阴影，分布范围达到4个肺区，同时出现胸膜斑并已累及部分心缘或膈面。